去除植物油中黄曲霉毒素B₁及3，4-苯并（a）芘的共同措施是
A. 加热
B. 用氨处理
C. 活性炭吸附
D. 提取
E. 日晒

正确答案：C。活性炭吸附